对单纯性肥胖患者的身体活动建议，不正确的是
A. 起始运动强度应保持在高强度运动
B. 减轻体重过程中应强调肌肉力量训练
C. 先对患者进行运动前风险评估
D. 以增加能量留耗、减轻体重为目的
E. 运动形式以大肌肉群参加与的有氧耐力运动为主

正确答案：A。起始运动强度应保持在高强度运动

解析：单纯性肥胖患者的身体活动：以增加能量留耗、减轻体重为目的（D对），先对患者进行运动前风险评估（C对），起始运动强度应保持在中等强度运动（A错，为本题正确答案），运动形式以大肌肉群参加与的有氧耐力运动为主（E对），减轻体重过程中应强调肌肉力量训练（B对）。